一侧肾癌主要治疗方法是
A. 肾肿瘤切除术
B. 单纯肾切除
C. 根治性肾切除术
D. 输尿管全切除
E. 化疗

正确答案：C。根治性肾切除术

解析：一侧肾癌主要治疗方法是根治性肾切除术（C对），切除范围包括患肾、肾周脂肪及肾周筋膜、区域肿大淋巴结及髂血管分叉以上的输尿管（D错）。肾肿瘤切除术（A错）主要用于肿瘤位于肾上、下极或肾周边、单发，肿瘤最大径＜4cm的肾癌。单纯肾切除（B错）可用于肾癌的治疗，但疗效不及根治性肾癌切除术，现较少使用。肾癌具有多药物耐药基因，对放射治疗及化疗（E错）不敏感。